药品的生产企业、经营企业、研究机构，未按照规定实施相应质量管理规范且逾期不改正的，应
A. 责令停产、停业整顿，并处5千元以上2万元以下的罚款
B. 处2万元以上10万元以下的罚款
C. 5年内不受理其申请，并处1万元以上3万元以下的罚款
D. 责令改正，给予警告，对单位并处3万元以上5万元以下的罚款
E. 给予降级、撤职、开除处分，并处3万元以下的罚款

正确答案：A。责令停产、停业整顿，并处5千元以上2万元以下的罚款

解析：本题考查药品管理。药品的生产企业、经营企业、研究机构，未按照规定实施相应质量管理规范且逾期不改正的，应责令停产、停业整顿，并处5千元以上2万元以下的罚款（A对）。